急进性肾炎常见于
A. 微小病变
B. 毛细血管内增生性肾炎
C. 系膜增生性肾炎
D. 新月体肾炎
E. 系膜毛细血管性肾炎

正确答案：D。新月体肾炎

解析：急进性肾炎常见于新月体肾炎（D对）。急性肾炎病理类型为毛细血管内增生性肾炎（B错）。肾病综合征的主要病理类型有微小病变（A错）、局灶节段性肾小球硬化、膜性肾病、系膜增生性肾炎（C错）、系膜毛细血管性肾炎（E错）等。